卡环臂的起始部分位于观测线上
A. 起稳定作用，防止义齿侧向移位
B. 起固位稳定作用，防止义齿（牙合）向脱位
C. 起固位作用，防止义齿龈向移位
D. 起稳定支持作用，防止义齿龈向移位
E. 起支持作用，防止义齿龈向移位

正确答案：A。起稳定作用，防止义齿侧向移位

解析：卡环臂：为卡环的游离部分，富有弹性，环绕基牙。卡环臂尖位于倒凹区，是卡环产生固位作用的部分，可防止义齿（牙合）向脱位。卡环臂起始部分较坚硬，放置在观测线上或非倒凹区，起稳定作用，防止义齿侧向移位。掌握“局部义齿固位体”知识点。